关于产褥感染的描述，以下哪项正确
A. 产后病原菌侵入全身任何组织或器官，造成局部和全身感染
B. 产后病原菌侵入生殖道造成的生殖系统的感染
C. 产后病原菌侵入生殖道和乳腺组织，造成局部和全身感染
D. 产褥感染是产妇死亡的第一位原因
E. 产后4周内，体温至少2次达到或超过38℃者，称为产褥病率

正确答案：B。产后病原菌侵入生殖道造成的生殖系统的感染